男性，4岁。诉发音不清求治。口腔检查：舌不能自由前伸，伸舌时舌尖部呈“M”形，智力发育正常。根据诊断合适的治疗是
A. 请儿科医生诊治智力发育问题
B. 舌系带修整术
C. 进行儿童心理指导
D. 纠正不正确的发音
E. 以上均合适

正确答案：B。舌系带修整术

解析：本题考查舌系带矫正术。该患儿最可能的诊断是舌系带过短，为改善发音不清的症状，应行舌系带修整术（B对）。该患儿无智力发育缺陷，不必请儿科医生诊治智力发育问题（A错）。舌系带过短会影响发音问题，但不一定引起心理问题，且题干中未明确说明患儿心理异常，不必进行儿童心理指导（C错）。仅凭纠正不正确发音（D错）是不能解决问题的，舌系带过短是生理缺陷，还需借助手术才能解决问题。